下列属于不完全性骨折的是
A. 横形骨折
B. 裂缝骨折
C. 压缩性骨折
D. 螺旋形骨折
E. 嵌插骨折

正确答案：B。裂缝骨折

解析：裂缝骨折属于不完全性骨折（B对）。